男性，28岁，水肿伴腰酸5年，血压160/100mmHg，尿蛋白（﹢﹢﹢），血浆清蛋白25g/L，最可能诊断是
A. 慢性肾小球肾炎普通型
B. 慢性肾小球肾炎高血压型
C. 慢性肾小球肾炎急性发作
D. IgA肾病
E. 肾病综合征

正确答案：E。肾病综合征